肘窝内的肱动脉位于
A. 肱桡肌内侧
B. 肢桡肌外侧
C. 肱二头肌腱外侧
D. 肱二头肌腱内侧
E. 喙肱肌内侧

正确答案：D。肱二头肌腱内侧

解析：肘窝内的肱动脉位于肱二头肌腱内侧（D对），其在平桡骨颈的高度分为桡动脉和尺动脉。